生物性有害因素所致病损的预防对策：毒毛皮炎
A. 做好检疫隔离、疫情预报、疫源地消毒、预防接种和个人防护
B. 防霉和防尘，加强个人防护和定期健康监护
C. 诱蛾、捉虫、杀虫，作业时注意个人防护
D. 治疗钩虫病患者，粪便封存无害化使用，穿鞋袜、长裤作业
E. 结合施肥消灭椎实螺，粪便无害化处理和个人防护（涂5%松香凡士林软膏）

正确答案：C。诱蛾、捉虫、杀虫，作业时注意个人防护